应当体现中医药特色，遵循中医药自身的发展规律的是
A. 与中医药有关的评审或者鉴定活动
B. 中医药专业技术职务任职资格评审
C. 获得定点资格的中医医疗机构
D. 非营利性中医医疗机构
E. 中医药人员培训规划

正确答案：A。与中医药有关的评审或者鉴定活动

解析：《中医药法》规定，开展法律、行政法规规定的与中医药有关的评审、评估、鉴定活动（A对），应当成立中医药评审、评估 鉴定的专门组织或者有中医药专家参加。中医药有其自身特点和规律，应坚持同行评议原则，避免用西医西药的标准衡量中医中药，确保评审、评估、鉴定活动的过程和结果体现医药特色、遵循中医药发展规律（BCDE错）。